中医典籍中有“天人合一”“天人相应”的观点。该观点所反映的医学模式为
A. 神灵主义医学模式
B. 整体医学模式
C. 生物医学模式
D. 生物-心理-社会医学模式
E. 自然哲学医学模式

正确答案：E。自然哲学医学模式

解析：医学模式的发展经历了以下几个阶段：①神灵主义医学模式（A错）：大约形成于1万年以前的原始社会，由于当时的生产力平极为低下，科学思想尚未建立，人们对健康和疾病的理解是超自然的，相信“万物有灵”，认为人类的生命和健康由神灵所主宰，疾病和灾祸是天谴神罚。②自然哲学医学模式（E对）：公元前3000年前后开始出现，中医典籍中有关“天人合一”、“天人相应”的观点，正是这一模式的反应，这一观点至今仍有一定的指导意义，但毕竟是基于朴素的唯物论，带有一定的局限性。③生物医学模式（C错）：形成于欧洲14～17世纪的文艺复兴运动，哈维等人提出的血液循环学说，把医学推向了一个新的时期，这就是以生物躯体为中心的生物医学观的时期。④生物-心理-社会医学模式（D错）：该模式认为，在思考人类的疾病和健康问题的时候，无论是致病、治病、预防及康复，都应将人视为一个整体，充分考虑到心理因素和社会因素的作用，综合考虑各方面因素的交互作用，而不能机械的将它们分割开。